男，54岁。2型糖尿病15年，长期口服格列本脲，10mg/d。查体：血压140/90mmHg，心肺和腹部检查未见异常，双下肢无水肿。眼底检查：视网膜病变Ⅲ期。空腹血糖6.8mmol/L，餐后2小时血糖10.6mmol/L，血尿素氮6.2mmol/L，血肌酐92.5mmol/L。尿液检查尿糖50mmol/L，蛋白阴性。经检查为糖尿病早期肾病，治疗应首选
A. 利尿剂
B. 血管紧张素转换酶抑制剂
C. α受体阻滞剂
D. β受体阻滞剂
E. 钙通道阻滞剂

正确答案：B。血管紧张素转换酶抑制剂

解析：中年男性患者，长期2型糖尿病病史，经检查为糖尿病早期肾病，对此治疗应首选血管紧张素转换酶抑制剂（B对），因为血管紧张素转换酶抑制剂不仅可以降低血压，还可以减轻肾小球基底膜的损害，减少蛋白尿，保护肾功能。而利尿剂（A错）、α受体阻滞剂（C错）、β受体阻滞剂（D错）、钙通道阻滞剂（E错）均属对症治疗，无保护肾功能的作用。